自然灾害发生后，饮用水消毒极少使用的是
A. 漂白粉类（如漂白粉片、漂白粉精片）
B. 有机氯胺类（如氯氨T、清水龙）
C. 氯氰脲酸类（如二氯异氰尿酸钠等）
D. 2%碘酒或高锰酸钾颗粒
E. 紫外线消毒方法

正确答案：E。紫外线消毒方法

解析：本题考查自然灾害发生后，饮用水消毒方法。自然灾害发生后，常用便于携带的饮用水消毒剂有：漂白粉类（漂白粉片、漂白粉精片）（A对）、有机氯胺类（氯胺T、清水龙）（B对）、氯氰脲酸类（二氯异氰尿酸钠、三氯异氰尿酸钠、氯溴异氰酸）等（C对）含氯消毒剂。在紧急情况下，缺少含氯消毒剂时，可使用2%碘酒（8～10滴/升水）、高锰酸钾颗粒（使水微红）消毒饮水（D对），10～15分钟可饮用。紫外线消毒方法（E错，为本题正确答案）极少用于饮用水消毒。